流行性腮腺炎可出现腮腺管开口处黏膜红肿，其部位在
A. 上颌第二臼齿相对应的颊黏膜上
B. 下颌第二臼齿相对应的颊黏膜上
C. 舌下
D. 上颌第一臼齿相对应的颊黏膜上
E. 下颌第一臼齿相对应的颊黏膜上

正确答案：A。上颌第二臼齿相对应的颊黏膜上

解析：流行性腮腺炎可出现腮腺管开口处黏膜红肿，其部位在上颌第二臼齿相对应的颊黏膜上（A对）。